某妇女，患病后开始积极锻炼身体，注意日常饮食。她的儿子虽然没病，在她的影响下也开始进行规律的体育锻炼，多吃蔬菜、水果了。该妇女的行为是因为
A. 认识到运动对健康的好处
B. 认识到控制饮食对健康的好处
C. 认识生活方式与健康的关系
D. 意识到患病的威胁
E. 不想再患病

正确答案：C。认识生活方式与健康的关系